胆汁中最重要的有机成分是
A. 胆色素
B. 胆汁酸
C. 胆固醇
D. 磷脂
E. 黏蛋白

正确答案：B。胆汁酸